肌纤维出坐骨大孔、止于股骨大转子的肌是
A. 臀大肌
B. 臀小肌
C. 梨状肌
D. 闭孔内肌
E. 闭孔外肌

正确答案：C。梨状肌

解析：梨状肌（C对）肌纤维出坐骨大孔、止于股骨大转子。